下列影响合理用药的因素中，药师不承担责任的是
A. 对疾病诊断错误而用错药
B. 对处方的配伍禁忌审查不严
C. 对病人用药的禁忌证审查不严
D. 对病人处方调配操作失误
E. 对病人用药的注意事项未作交待

正确答案：A。对疾病诊断错误而用错药